男，56岁。吞咽困难5个月。胃镜检查见食管中段隆起伴溃疡，管腔狭窄，管壁僵硬。黏膜活检最可能的病理改变是
A. 腺癌
B. 淋巴瘤
C. 非干酪样肉芽肿
D. 鳞癌
E. 干酪样肉芽肿

正确答案：D。鳞癌

解析：患者男性，56岁，主要症状为吞咽困难，胃镜检查见食管中段隆起伴溃疡，管腔狭窄，管壁僵硬，管壁僵硬，考虑诊断食管癌。食管癌黏膜活检最可能的病理改变是鳞癌（ D对）。腺癌（A错）可见于肺周围癌，淋巴瘤（B错）患者常有淋巴结肿大、肝脾肿大等临床表现。非干酪性肉芽肿（C错）是炎症局部巨噬细胞及其衍生细胞增生形成境界清楚的结节状病灶，是肉芽肿性炎的特征。干酪样肉芽肿（E错）常见于结核患者，常有低热、盗汗等结核中毒症状。